眼球角膜的神经支配是
A. 视神经
B. 动眼神经
C. 滑车神经
D. 眼神经
E. 椭圆囊斑

正确答案：D。眼神经

解析：眼球角膜的神经支配是眼神经（D对）。